医疗事故的主体是医疗机构及其医务人员，这里所说的医务人员是指
A. 本院的医师护士
B. 依法注册的医师护士
C. 本院的医师护士以及外聘人员
D. 本院从事医疗活动所有有关人员
E. 本院从事医疗活动的所有相关医疗技术人员

正确答案：E。本院从事医疗活动的所有相关医疗技术人员

解析：发生“医疗事故”的主体是医疗机构及其医务人员。“医疗机构”是指按照国务院1994年2月发布的《医疗机构管理条例》取得《医疗机构执业许可证》的机构；“医务人员”是指依法取得执业资格的医疗专业技术人员，即本院从事医疗活动的所有相关医疗技术人员（E对），如医师和护士等。